黄体萎缩不全所致的功血，哪项是错误的
A. 生育年龄妇女居多
B. 月经周期正常而经期延长
C. 阴道脱落细胞检查可以确诊
D. 基础体温双相，但不典型，体温下降延迟；
E. 于月经第5天刮宫，见有分泌反应

正确答案：C。阴道脱落细胞检查可以确诊

解析：子宫内膜不规则脱落多见于生育年龄妇女，月经周期正常，经期延长，常达9～10天，失血量多。因为有排卵，所以基础体温呈双相型，但不典型。体温下降延迟，于月经第5～6天刮宫，见到子宫内膜具有分泌反应的腺体。阴道脱落细胞学检查作为辅助手段可以判断有无排卵，但不能确诊是子宫内膜不规则脱落所致的功血。掌握“功能失调性子宫出血”知识点。